患者，女，62岁，闭角型青光眼病史5年。近半年出现手抖、搓丸样动作、慌张步态等，诊断为帕金森病。宜选用的药物是
A. 恩他卡朋双多巴
B. 多奈哌齐
C. 复方左旋多巴
D. 苯海索
E. 普拉克索

正确答案：E。普拉克索

解析：本题考查帕金森病的药物治疗。普拉克索（E对）为多巴胺受体激动剂，尤其适用于早发型帕金森病患者的病程初期。